下列解表药中兼有化湿和中功效的是
A. 紫苏
B. 香薷
C. 生姜
D. 白芷
E. 防风

正确答案：B。香薷

解析：该题考查香薷的功效，属记忆内容。香薷功效发汗解表，化湿和中，利水消肿（B对）。